尿毒症患者血液系统的临床表现为
A. 低色素、小细胞性贫血
B. 白细胞出现中毒颗粒、核左移
C. 血小板异常增多
D. 贫血常为中重度
E. 促红细胞生成素增加

正确答案：B。白细胞出现中毒颗粒、核左移

解析：慢性肾衰竭患者由于肾组织分泌促红细胞生成素减少（E错），往往有轻、中度贫血（D错），多为正细胞正色素性贫血（A错），由于尿毒症患者贫血是由于促红细胞生成素减少所致，故称为肾性贫血，由于血小板功能降低，晚期慢性肾衰竭患者有出血倾向（C错）。尿毒症患者因代谢紊乱所至于的代谢性中毒，可有白细胞出现中毒颗粒核左移（B对）。急性中毒包括代谢紊乱所致的代谢性中毒：如糖尿病酮症酸中毒、尿毒症等，急性化学性药物中毒，生物中毒。